患者，男，70岁。胸闷胸痛反复发作，心悸少寐，气短乏力，五心烦热，汗多口干，眩晕耳鸣，两颧潮红，舌红少苔，脉细数无力。心电图示：Ⅱ、Ⅲ、aVF导联S-T段下移，T波倒置，心肌酶谱正常。其诊断是
A. 高血压性心脏病，气阴两虚证
B. 冠状动脉粥样硬化性心脏病心绞痛，气阴两虚证
C. 冠状动脉粥样硬化性心脏病心绞痛，寒痰痹阻证
D. 冠状动脉粥样硬化性心脏病心绞痛，痰瘀痹阻证
E. 急性心肌梗死，气阴两虚证

正确答案：B。冠状动脉粥样硬化性心脏病心绞痛，气阴两虚证

解析：临床表现为胸闷胸痛反复发作，心电图示Ⅱ、Ⅲ、aVF导联S-T段下移，T波倒置（与冠心病心绞痛发作心电图典型表现，即以R波为主的导联中，出现ST段压低≥0.1mV，有时出现T波倒置相符），诊断考虑为冠状动脉粥样硬化性心脏病心绞痛，患者胸闷胸痛反复发作，心悸少寐，气短乏力，五心烦热，汗多口干，眩晕耳鸣，两颧潮红，舌红少苔，脉细数无力，此为气阴两虚证的表现（B对）。老年男性患者，无高血压病病史，故先排除高血压性心脏病诊断（A错），急性心肌梗死患者有心肌酶谱的异常改变，本题患者心肌酶谱正常（E错）。寒痰痹阻证可见胸闷心痛，遇冷加重，痰多脘痞等症（C错）。痰瘀痹阻证可见胸部刺痛，痛处固定不移，胸闷，舌质紫暗或有瘀斑，舌苔白腻，脉弦涩等症（D错）。